乌头碱是乌头类药物的主要有毒成分，其一般中毒量为
A. 0.1mg
B. 0.2mg
C. 0.5mg
D. 1mg
E. 2mg

正确答案：B。0.2mg

解析：本题考查的是乌头类药物的中毒机制。乌头碱是乌头类药物的主要有毒成分，其一般中毒量为0.2mg（B对）。乌头类药物的中毒机制：主要有毒成分为乌头碱，一般中毒量为0.2mg，致死量为2～4mg。其毒性主要作用于神经系统，尤其是迷走神经等，使其先兴奋后抑制，并可直接作用于心脏，产生异常兴奋，可致心律失常，甚至引起室颤而死亡。